下列哪项不是敏感人群的影响因素
A. 遗传
B. 年龄
C. 职业
D. 性别
E. 健康状况

正确答案：C。职业

解析：本题考查敏感人群的影响因素。在接触有害物质时，由于个体生物学因素使其毒性反应的出现较普通人群更早反应更强的人群，称为敏感人群。其影响因素有遗传（A对）、年龄（B对）、性别（D对）、健康状况（E对）等。职业（C错，为本题正确答案）不是敏感人群的影响因素。